患儿，男，12岁。因烧伤面积较大，症见壮热烦渴，躁动不安，口干唇焦，呼吸气粗，鼻翼煽动，大便秘结，小便短赤，舌红苔黄糙，脉弦数。其证候是
A. 火热伤津
B. 阴伤阳脱
C. 火毒内陷
D. 气血两虚
E. 脾胃虚弱

正确答案：C。火毒内陷

解析：该患儿烧伤，火毒炽盛故见壮热不退，火毒传心，可见烦躁不安躁动不安，火邪伤阴故见口干唇燥、大便秘结，小便短赤，火毒传肺，可见呼吸气粗，鼻翼煽动，舌脉亦符合火毒内陷之象（C对）。火热伤津不致呼吸气粗，鼻翼煽动（A错）。阴伤阳脱多见神疲倦卧，面色苍白，呼吸气微，表情淡漠，嗜睡，自汗肢冷，体温不升反低，尿少；全身或局部水肿，创面大量液体渗出；舌淡暗苔灰黑，或舌淡嫩无苔，脉微欲绝或虚大无力等（B错）。气血两虚可见神疲乏力，面色无华，唇淡，脉细弱等（D错）。脾胃虚弱可见食少纳呆，腹胀便溏等（E错）。